诊断抑郁症的首要症状是
A. 精力明显減退、疲乏
B. 思维困难、联想缓慢
C. 情绪低落、兴趣下降
D. 自卑、自责、自杀观念
E. 失眠早醒、体重减轻

正确答案：C。情绪低落、兴趣下降

解析：抑郁症是各种原因引起的以心情低落为主要症状的一种疾病，患者常有兴趣丧失、自罪感、注意困难、食欲丧失和自杀观念， 并有其他的认知、行为和社会功能的异常。临床表现既往将抑郁症的表现概括为“三低症状”，即情绪低落、思维迟缓、意志减退。因此，诊断抑郁症的首要症状是情绪低落，兴趣下降（C对）。题中所述症状均是抑郁症的临床表现，但不一定均能见于所有抑郁症患者（ABDE错）。